男性，50岁。无“三多一少”症状，空腹血糖6.5mmol/L，有糖尿病家族史，疑糖尿病就诊，下列哪项试验最具诊断意义
A. 尿糖定性
B. 24小时尿糖定量
C. 餐后血糖
D. 葡萄糖耐量﹢胰岛素释放试验
E. 糖化血红蛋白

正确答案：D。葡萄糖耐量﹢胰岛素释放试验